正确描述肾动脉的是
A. 只分布到肾
B. 在肾实质内按节段分布
C. 经肾静脉、肾盂后方入肾门
D. 左、右肾动脉一样长
E. 左肾动脉较右肾动脉长

正确答案：B。在肾实质内按节段分布

解析：肾动脉在进入肾门之前发出肾上腺下动脉至肾上腺（A错）。肾动脉在肾实质内按节段分布（B对）。